传染性非典型肺炎潜伏期为
A. 1～14天，通常在2～10天
B. 8～20天，通常在8～10天
C. 15～30天，通常在10～18天
D. 15～20天，通常在10～15天
E. 1～30天，通常在10～15天

正确答案：A。1～14天，通常在2～10天

解析：SARS的潜伏期通常限于2周之内，1～14天，一般2～10天（A对）。SARS临床分为3期，早期：一般为病初的1～7天。起病急，以发热为首发症状，半数以上的患者伴有头痛、关节肌肉酸痛、乏力等症状，部分患者有干咳、胸痛、腹泻等。大多患者在病程7天内出现肺部影像改变。进展期：多发生在病程的8～14天，个别患者更长。在此期，发热及感染中毒症状持续存在，肺部病变进行性加重。恢复期：进展期过后，体温逐渐下降，临床症状缓解，肺部病变开始吸收，多数患者经2周左右的恢复，可达出院标准。